男，32岁。支气管哮喘10年，近两天受凉后再发胸闷，咳嗽，喘息，查体少许散在哮鸣音。则最有效的治疗是
A. 静滴糖皮质激素
B. 间断特布他林
C. 静滴沙丁胺醇
D. 口服色苷酸钠
E. 口服扎鲁司特

正确答案：A。静滴糖皮质激素

解析：患者长期患有支气管哮喘，近两天受凉后再度发作，查体有散在的哮鸣音，表明患者哮喘处于急性发作期，发作程度应为轻度，糖皮质激素是目前控制哮喘最有效的药物，所以最有效的治疗是静滴糖皮质激素（A对）。SABA为控制哮喘急性发作的首选药，现在多推荐吸入法，因为药物可直接吸入气道，作用迅速，全身副作用少，常用药物为沙丁胺醇和特布他林（BC错）。色甘酸钠（D错）属于肥大细胞稳定剂，扎鲁司特（E错）属于白三烯调节剂，二者属于哮喘治疗的需要长期使用的药物，通常不用于哮喘急性发作期的治疗。